内服琥珀的方法是
A. 捣汁服
B. 烊化服
C. 水煎服
D. 熬膏服
E. 研末冲服

正确答案：E。研末冲服

解析：本题考查的是琥珀的用法用量。内服琥珀的方法是研末冲服（E对）。琥珀：【用法用量】内服：研末冲，或入丸散，1.5～3g；不入煎剂（C错）。外用：适量，研末干掺，或调敷。可捣汁服（A错）的有生姜、葛根、浮萍、芦根、生地黄、马齿苋、垂盆草、金钱草、小蓟、白茅根、藕节、景天三七等。可烊化服（B错）的一般为胶类中药。胶类中药不宜与群药同煎，以免因煎液黏稠而影响其他药物成分的煎出或结底煳化。可将此类药置于已煎好的药液中加热溶化后一起服用。也可将此类药置于容器内，加适量水，加热溶化或隔水炖化后，再兑入群药煎液中混匀分服。如阿胶、鳖甲胶、鹿角胶、龟鹿二仙胶等煎膏服（D错）系指中药饮片用水煎煮，煎液浓缩，加炼蜜或炼糖（或转化糖）制成的半流体制剂，俗称膏滋